关于各心腔附着结构的描述，错误的是
A. 三尖瓣连于右房室口
B. 二尖瓣连于左房室口
C. 上腔静脉开口于右心房
D. 左房室口连接主动脉瓣
E. 冠状窦开口于右心房

正确答案：D。左房室口连接主动脉瓣

解析：三尖瓣连于右房室口（A对）。二尖瓣连于左房室口（B对）。右心房内有上腔静脉开口（C对）、冠状窦口（E对）。主动脉瓣连接主动脉口（D错，为本题正确答案）。